下列属于选择性α₂受体阻断剂
A. 哌唑嗪
B. 特拉唑嗪
C. 坦舒洛辛
D. 多沙唑嗪
E. 育亨宾

正确答案：E。育亨宾

解析：育亨宾为选择性α₂受体阻断药（E对），进入中枢神经系统，阻断α₂受体，可促进去甲肾上腺素能神经末梢释放去甲肾上腺素，增加交感神经张力，导致血压升高，心率加快。哌唑嗪、特拉唑嗪、坦舒洛辛、多沙唑嗪为选择性α₁受体阻断药（ABCD错）。